我国现阶段采用的围产期是指
A. 从妊娠满28周至产后6周
B. 从妊娠满28周至产后4周
C. 从妊娠满20周至产后1周
D. 从妊娠满28周至产后1周
E. 从胚胎成型至产后1周

正确答案：D。从妊娠满28周至产后1周

解析：从妊娠满28周至产后4周（B错），从妊娠满28周至产后1周都是围生期的表达，但我国目前采用从妊娠满28周至产后1周（D对）作为围生期定义。